五行学说指导诊断，面见赤色，脉见洪象，则病位在
A. 肺
B. 肾
C. 心
D. 肝
E. 脾

正确答案：C。心

解析：《黄帝八十一难经》：“十五难曰：经言春脉弦，夏脉钩，秋脉毛，冬脉石…四时之脉也。”钩脉即洪脉，洪脉与夏相应，夏在五行中属火，心主血脉而主神明，故归属于火，赤色与火颜色类似，属火（C对）。肺病面见白色，脉见浮脉（A错）。肾病面见黑色，脉见沉脉（B错）。肝病面见青色，脉见弦脉（D错）。脾病则面见黄色（E错）。